固定义齿中起固位作用的结构是
A. 基牙
B. 固位体
C. 连接体
D. 牙槽嵴和黏膜
E. 桥体

正确答案：B。固位体

解析：固定义齿中起固位作用的结构是固位体。掌握“固定桥的组成和分类”知识点。